我国居民膳食中，热能的主要食物来源是
A. 动物肝脏
B. 奶及奶制品
C. 蔬菜、水果
D. 豆类
E. 粮谷类

正确答案：E。粮谷类

解析：我国居民膳食中热能的主要食物来源为粮谷类等淀粉性食物。掌握“合理营养指导”知识点。